充血性心力衰竭加重期出现少尿，血BUN/Cr＞20，尿比重1.025，最可能的诊断是
A. 急进性肾小球肾炎
B. 急性间质性肾炎
C. 急性肾小管坏死
D. 肾前性急性肾衰
E. 肾后性急性肾衰竭

正确答案：D。肾前性急性肾衰

解析：充血性心力衰竭加重期出现少尿说明有效循环血容量严重不足（肾前性氮质血症病因），血BUN/CR＞20（肾前性AKI血BUN/CR＞20），尿比重1.025（肾前性AKI尿比重＞1.018），故最可能的诊断为肾前性急性肾衰（肾前性氮质血症）（D对）。急进性肾小球肾炎起病急，病情急骤发展，病理检查为新月体肾炎（A错）。急性间质性肾炎常有发热、皮疹、关节酸痛和腰背痛（B错）。急性肾小管坏死血BUN/CR＜10-15，尿比重＜1.012（C错）。肾后性急性肾衰竭一般见于尿路梗阻（E错）。